治疗钩虫病宜选用
A. 甲硝唑
B. 甲苯咪唑
C. 吡喹酮
D. 氯喹
E. 恩波维铵

正确答案：B。甲苯咪唑

解析：本题考查甲苯咪唑。治疗钩虫病宜选用甲苯咪唑（B对）。甲苯咪唑和阿苯达唑是治疗蛔虫病、蛲虫病、钩虫病和鞭虫病的首选药。甲硝唑（A错）可作为阴道滴虫病的首选药。吡喹酮（C错）为抗血吸虫病药。氯喹（D错）为抗疟药。恩波维铵（E错）是治疗蛲虫病的首选药。